呼吸呈蒜味的毒物是
A. 阿托品
B. 安定
C. 酒糟
D. 有机磷农药
E. 亚硝酸盐

正确答案：D。有机磷农药

解析：OPI（有机磷农药）中毒患者呼出气体呈蒜味（D对）。酒精（C错）中毒患者呼出气体呈酒味。阿托品（A错）、安定（地西泮）（B错）及亚硝酸盐（E错）中毒呼出气体无异常气味。